树脂类黏结剂的优点不包括
A. 难溶于唾液
B. 黏结力强
C. 无牙髓刺激
D. 可与牙本质黏结
E. 可与金属黏结

正确答案：C。无牙髓刺激

解析：复合树脂对牙髓的刺激的主要原因是复合树脂中的残留单体的溶出和聚合产热。掌握“修复材料、金瓷结合及树脂粘结机制”知识点。